Th1细胞效应激活巨噬细胞杀伤胞内寄生菌是因为Th1细胞产生
A. IFN-α
B. IFN-β
C. IFN-γ
D. IFN-ε
E. IFN-η

正确答案：C。IFN-γ

解析：Th1细胞通过产生IFN-γ，激活巨噬细胞杀伤胞内寄生菌，这是清除胞内寄生菌如结核杆菌、布氏杆菌和麻风杆菌的主要方式。掌握“B细胞、T细胞介导的免疫应答”知识点。